下列关于问题设计说法不正确的是
A. 开放式问题能收集到生动的资料
B. 封闭式问题有固定的备选答案
C. 问卷中的问题分为开放式和封闭式
D. 封闭式问题容易回答，节省时间
E. 问卷调查多采用开放式问题为主

正确答案：E。问卷调查多采用开放式问题为主

解析：本题考查问题设计的相关内容。问卷中的问题分为开放式和封闭式（C对），开放式问题能收集到生动的资料（A对），封闭式问题有固定的备选答案（B对），问题容易回答，节省时间（D对）。由于开放式问题在适用范围和统计分析等方面的缺陷，目前的问卷调查多以采用封闭式问题为主（E错，为本题正确答案），但在问卷设计者不能肯定问题的所有答案或者要了解一些新情况时，也可用开放式问题。